女，38岁，突发心悸伴烦躁和胸闷30分钟，四肢发凉，曾出现黑朦，收入急诊监护病房。查体：BP70/50mmHg，心率180次/分，心律绝对不齐，心音强弱不等，心脏各瓣膜区未闻及杂音，心电图提示“预激综合征伴心房颤动”。该患者最适宜的处理是
A. 静眿注射胺碘酮
B. 静脉注射维拉帕米
C. 电复律
D. 静脉注射西地兰
E. 静脉注射普罗帕酮

正确答案：C。电复律

解析：患者中年女性，突发心悸、胸闷，曾出现黑朦（心排血量降低导致脑供血不足所致），BP70/50mmHg（正常值90～139/60～89mmHg，偏低），提示患者已有血流动力学紊乱，心电图提示“预激综合征伴心房颤动”，对预激综合征伴心房颤动的患者且有晕厥或低血压时，最适宜的处理是尽早电复律（C对），改善心脏射血功能。治疗药物可选用延长房室旁路不应期的药物，如静脉注射胺碘酮（A错）和静脉注射普罗帕酮（E错），但并非最适宜的处理。静脉注射维拉帕米（B错）对外周血管有扩张作用，使血压下降，但较弱，一般可引起心率减慢，但也可因血压下降而反射性加速患者的心室率，甚至会诱发心室颤动（P195）。西地兰（P175）（D错）为洋地黄类药物，主要用于急性左心衰竭的强心治疗。